慢性阻塞性肺疾病患者存在的“持续性气流受限”指的是
A. 阻塞性通气功能障碍不能完全恢复
B. 支气管舒张试验阳性
C. 功能残气量显著增加
D. 支气管激发试验阳性
E. 存在限制性通气功能障碍

正确答案：A。阻塞性通气功能障碍不能完全恢复

解析：慢阻肺特征性病理变化是持续性气流受限，其气流受限多呈进行性发展，为不可逆改变，故不能完全恢复（A对）；支气管舒张试验阳性（B错），提示气道存在可逆性的气道阻塞；功能残气量显著增加（C错），表明肺过度充气，不特异；支气管激发试验阳性（D错），提示存在气道高反应性；限制性通气障碍和气体交换障碍（E错），是间质性肺疾病的特征表现。